氯丙嗪导致锥体外系反应是由于
A. α-受体阻断作用
B. 阻断结节-漏斗通路的D₂-受体
C. M-受体阻断作用
D. 阻断黑质-纹状体通路的D₂-受体
E. 阻断黑质-纹状体通路的D₁-受体

正确答案：D。阻断黑质-纹状体通路的D₂-受体